帕金森病患者可出现症状是
A. 静止性震颤
B. 意向性震颤
C. 运动共济失调
D. 骨骼肌张力降低
E. 皮肤感觉迟钝

正确答案：A。静止性震颤

解析：帕金森病又名震颤麻痹，是一种常见于中老年的神经系统变性疾病，临床上以静止性震颤（A对）、运动迟缓、肌强直和姿势平衡障碍为主要特征。静止性震颤常为首发症状，多始于一侧上肢远端，静止位时出现或明显，随意运动时减轻或停止，紧张或激动时加剧，入睡后消失。典型表现是拇指与示指呈“搓丸样”动作，频率为4-6Hz。令患者一侧肢体运动如握拳或松拳，可使另一侧肢体震颤更明显，该试验有助于发现早期轻微震颤。意向性震颤（B错）是指出现于随意运动时的震颤，其特点是在有目的运动中或将要达到目标时最为明显，常见于小脑及其传出通路病变时。运动共济失调（C错）是肌力正常的情况下出现的运动协调障碍，临床表现为肢体随意运动的幅度及协调发生紊乱，不能维持躯体姿势和平衡，主要反映小脑半球及其与对侧额叶皮质间联系的损害。帕金森病患者肌强直常见，而不是骨骼肌张力减低（D错）；运动迟缓常见而不是皮肤感觉迟钝（E错）。